女，32岁，停经56天，3天前开始有少量断续阴道出血，昨日始右下腹轻痛，今日疼痛加剧，呕吐2次。妇检：子宫口闭，宫颈举痛（+），子宫前倾前屈，较正常稍大，软，子宫右侧可触及拇指大小较软之块物，尿hCG（±），后穹隆穿刺吸出10ml不凝血液，血象：白细胞10×109/L，中性0.8，血红蛋白75g/L，体温37.5℃，血压10/6kPa（75/45mmHg）处理方法下列哪项是正确的
A. 抗休克同时立即手术
B. 白细胞较高先用抗生素
C. 次日复验hCG定量
D. 为排除流产可能先刮宫
E. 药物止血

正确答案：A。抗休克同时立即手术

解析：考虑宫外妊娠，也就是输卵管妊娠，这种情况建议手术治疗。现在已经腹痛加剧，后穹窿穿刺出10ml不凝血，最好的治疗方案就是马上做手术。掌握“异位妊娠”知识点。